伤寒、副伤寒防疫措施
A. 隔离病人
B. 终末消毒
C. 两者均要
D. 两者均不要

正确答案：C。两者均要

解析：本题考查伤寒、副伤寒防疫措施。伤寒、副伤寒属于我国法定报告乙类传染病，其防疫措施是隔离病人（A对）和终末消毒（B对CD错）。隔离病人是将其与周围易感者分隔开来，减少或消除病原体扩散。终末消毒是当传染源痊愈、死亡或离开后对疫源地进行的彻底消毒，从而清除传染源所播散在外界环境中的病原体。